男性，30岁，身高处于其年龄相应标准的第3百分位数之下。哪项不是矮身材的原因
A. 家族性矮身材
B. 体质性生长迟缓
C. 垂体性侏儒症
D. 甲状腺功能低下
E. 营养不良

正确答案：B。体质性生长迟缓